女，50岁。牙龈增生影响咀嚼一年。检查见全口牙龈肥大增生，覆盖牙面约1/2，结节状。探诊时有出血，个别牙龈增生严重处牙齿有移位。为了有助于诊断，最应该注意询问的病史为
A. 月经状况
B. 子女情况
C. 饮食状况
D. 服药史
E. 流行病学史

正确答案：D。服药史

解析：本题考查药物性牙龈增生的病史询问。导致牙龈增生的疾病主要有：药物性牙龈肥大增生：增生呈度相对较轻，增生牙龈一般覆盖牙冠1/3左右，龈乳头可呈结节状，增生的牙龈可将牙齿挤压移位；牙龈纤维瘤病：牙龈增生范围广、程度重，常覆盖牙冠的2/3以上；以增生为表现的慢性龈炎：增生程度相对比较轻，覆盖牙冠不超过1/3。根据病例所述，牙龈呈结节状，覆盖牙面约1/2，个别牙龈增生严重处牙齿有移位，可初步确定为药物性牙龈肥大增生，因此需要询问服药史（D对）。月经状况（A错）主要是针对妊娠期龈炎而言，药物性牙龈肥大增生不受月经状况的影响。子女情况（B错）主要是看子女有无类似疾病，对具有遗传可能性的牙龈纤维瘤病具有诊断意义。饮食状况（C错）主要针对某些由进食刺激性食物导致的牙龈病变的情况，药物性牙龈肥大增生不受饮食状况的影响。流行病学是研究特定人群中疾病、健康状况的分布及其决定因素，并研究防治疾病促进健康的策略和措施的科学，不存在流行病学史（E错）这一说法。